外阴硬化苔癣型营养不良的治疗，目前不主张采用的方法是
A. 口服脱敏药物
B. 手术治疗
C. 禁用刺激性药物擦洗
D. 激光治疗
E. 局部用药

正确答案：B。手术治疗

解析：外阴硬化苔癣型营养不良的治疗有：1.一般治疗，包括保持外阴部皮肤清洁、干燥，禁用刺激性药物擦洗（C对）；2.局部药物治疗（E对）；3.全身用药，精神紧张、瘙痒症状明显者，使用镇静、安眠和脱敏药物（A对）缓解；4.物理治疗，用聚焦超声和激光治疗（D对）；5.手术治疗（B错，为本题正确答案），因外阴硬化苔癣型营养不良的恶变机会很少，已很少采用。